咽结合膜热的病原是
A. 衣原体
B. 呼吸道合胞病毒
C. 流感病毒
D. 腺病毒
E. 柯萨奇病毒

正确答案：D。腺病毒

解析：咽-结合膜热由腺病毒3、7型所致，好发于春夏季。多呈高热，咽痛，眼部刺痛。体检时可见咽部充血，一侧或两侧滤泡性眼结合膜炎，颈部、耳后淋巴结肿大，病程约1～2周，故咽-结合膜热的病原是腺病毒（D对）。衣原体（A错）为介于立克次体和病毒之间的微生物，可引起沙眼、肺炎及泌尿道感染等多种疾病。呼吸道合胞病毒（B错）属副黏液病毒科，是引起小儿病毒性肺炎最常见的病原，可引起间质性肺炎，毛细支气管炎等。流感病毒（C错）属正黏液病毒科，可引起甲型流感、禽流感等多种急性呼吸道传染病。柯萨奇病毒（E错）为肠道病毒，可引起疱疹性咽峡炎、脊髓灰质炎、手足口病等。